治疗痉证邪壅经络证，应首选
A. 羌活胜湿汤
B. 葛根汤
C. 栝蒌桂枝汤
D. 羚角钩藤汤
E. 大定风珠

正确答案：A。羌活胜湿汤

解析：羌活胜湿汤祛风、胜湿、止痛，最宜治疗痉证邪壅经络证（A对）。葛根汤用于治疗痉证邪壅经络寒邪较甚，项背强急，肢痛拘挛，无汗，病属刚痉者，功能解肌发汗（B错）。栝蒌桂枝汤用于治疗痉证邪壅经络风邪偏盛，项背强急，发热不恶寒，汗出，头痛，病属柔痉者，功能和营养津（C错）。羚角钩藤汤为痉证肝经热盛证的选方，功能平肝息风，清热止痉（D错）。大定风珠常合四物汤治疗痉证阴血亏虚证，功能滋阴息风（E错）。